第三产程不应超过多少时间
A. 5分钟
B. 10分钟
C. 15分钟
D. 20分钟
E. 30分钟

正确答案：E。30分钟

解析：第三产程是从胎儿娩出后到胎盘胎膜娩出，即胎盘剥离和娩出的全过程，需5～15分钟，不应超过30分钟（E对）。